B细胞表面最重要的标志为
A. mlg
B. FcγR
C. CD40
D. CD5
E. CD80

正确答案：A。mlg